下列胃镜检查的描述中，对慢性萎缩性胃炎诊断最有意义的是
A. 胃黏膜粗糙不平，可见出血点/斑
B. 胃黏膜糜烂
C. 胃黏膜红白相间，皱襞增粗
D. 胃黏膜苍白平坦，黏膜血管透见
E. 胃黏膜充血，呈花斑状

正确答案：D。胃黏膜苍白平坦，黏膜血管透见

解析：慢性萎缩性胃炎胃黏膜由正常的橘红色变为灰色或灰绿色，黏膜层变薄，黏膜腺体减少或消失并伴有肠上皮化生，胃黏膜苍白平坦，黏膜下血管透见（D对），表面呈细颗粒状，偶有出血及糜烂（ABCE错）。